地表水有机氮和蛋白氮含量突然增高时，表明其最可能受到
A. 造纸厂污水污染
B. 石油化工厂废水污染
C. 地表径流污染
D. 人、畜粪便污染
E. 钢铁厂废水污染

正确答案：D。人、畜粪便污染

解析：本题考查地表水的污染。地表水有机氮和蛋白氮含量突然增高时，表明其最可能受到人、畜粪便污染（D对ABCE错）。人、畜粪便中含有大量的有机物质，其中包括有机氮和蛋白氮，这些物质可以通过地表径流进入地表水，从而导致地表水有机氮和蛋白氮含量的突然增高。